牙列缺损在哪种情况下应采用蜡堤记录上下颌关系
A. 口内缺牙数目少
B. 余留牙磨耗
C. 单个前牙缺失
D. 个别后牙缺失
E. 末端游离缺失

正确答案：E。末端游离缺失

解析：蜡（牙合）记录适用于口内缺牙少，但余留牙磨耗等导致垂直距离降低，需通过义齿修复来恢复正常垂直距离的情况。蜡堤记录多用于单侧或双侧游离缺失间隙，或较长的非游离缺隙。在口内余留牙能正常咬合，垂直距离和牙尖交错（牙合）存在，但模型上上下颌对合不稳定的情况。掌握“局部义齿颌位关系记录及人工牙选择”知识点。